患者，女，56岁，诊断为高血压伴快速型心律失常，首选的药物是
A. 维拉帕米
B. 氯沙坦
C. 螺内酯
D. 美托洛尔
E. 多沙唑嗪

正确答案：D。美托洛尔

解析：本题考查美托洛尔。美托洛尔（D对）属于β-受体阻断剂，适用于伴快速型心律失常、冠心病、慢性心力衰竭、交感神经活性增高、高动力状态的高血压患者。题干中患者高血压伴快速型心律失常，首选美托洛尔。维拉帕米（A错）为钙通道阻滞剂，用于心绞痛、心律失常、原发性高血压等。氯沙坦（B错）为肾素-血管紧张素活性药，用于治疗原发性高血压，可预防相关慢性疾病如高血脂、高血压、肥胖、高血糖等；对于合并有高血压的患者，治疗的同时注意血尿酸水平，特别是联合使用利尿剂时，必要时可选择兼具降压和降尿酸的血管紧张素受体拮抗剂(如氯沙坦）。螺内酯（C错）为保钾利尿药，用于水肿性疾病、高血压、原发性醛固酮增多症、低钾血症的预防。多沙唑嗪（E错）用于原发性轻、中高血压，对于单独用药难以控制血压的患者，可与利尿剂、β阻滞剂、钙拮抗剂或血管紧张素转化酶抑制剂（ACEI）合用，良性前列腺增生的对症治疗，适用于高血压伴前列腺增生症患者，也用于难治性高血压患者的治疗，开始用药应在入睡前，以防直立性低血压发生，直立性低血压者禁用，心力衰竭者慎用。